稳心颗粒除活血化瘀外，又能
A. 益气强心
B. 理气消积
C. 益气养血
D. 理气化痰
E. 益气养阴

正确答案：E。益气养阴

解析：本题考查的是稳心颗粒的功能。稳心颗粒除活血化瘀外，又能益气养阴（E对）。稳心颗粒：【功能】益气养阴，活血化瘀。麝香保心丸：【功能】芳香温通，益气强心（A错）。柴胡舒肝丸：【功能】疏肝理气，消胀止痛。方中陈皮、麸炒枳壳、木香、紫苏梗与乌药，五药合用，能理气消积（B错）而消胀止痛。人参再造丸：【功能】益气养血（C错），祛风化痰，活血通络。二陈丸：【功能】燥湿化痰，理气（D错）和胃。